冰硼散的功能是
A. 滋阴清热，解毒消肿
B. 消肿利咽，化腐止痛
C. 解毒化腐，敛疮生肌
D. 清热解毒，消肿止痛
E. 清热泻火，凉血解毒

正确答案：D。清热解毒，消肿止痛

解析：本题考查的是冰硼散的功能。冰硼散的功能是清热解毒，消肿止痛（D对）。冰硼散：【功能】清热解毒，消肿止痛。口炎清颗粒：【功能】滋阴清热，解毒消肿（A错）。六神丸：【功能】清热解毒，消肿利咽，化腐止痛（B错）。栀子金花丸：【功能】清热泻火，凉血解毒（E错）。功能为解毒化腐，敛疮生肌（C错）的中成药，2022年考试指南未明确说明。